嗅神经叙述错误的是
A. 即嗅丝
B. 由嗅球发出的周围突形成
C. 由双极嗅细胞中枢突形成
D. 穿筛板的筛孔
E. 分布于上鼻甲及其相对的鼻中隔黏膜

正确答案：B。由嗅球发出的周围突形成

解析：嗅神经为特殊内脏感觉纤维，由上鼻甲和鼻中隔上部黏膜内的嗅细胞中枢突聚集而成（B错，为本题正确选项）。